《互联网药品信息服务管理办法》规定，提供互联网药品信息服务的网站可以发布信息的产品有
A. 处方药
B. 第一类精神药品
C. 第二类精神药品
D. 戒毒药品
E. 医疗用毒性药品

正确答案：A。处方药

解析：本题考查《互联网药品信息服务管理办法》。《互联网药品信息服务管理办法》规定，提供互联网药品信息服务的网站可以发布信息的产品有处方药（A对）。《互联网药品信息服务管理办法》第九条规定，提供互联网药品信息服务的网站不得发布麻醉药品、精神药品（BC错）、医疗用毒性药品（E错）、放射性药品、戒毒药品（D错）和医疗机构制剂的产品信息。